肾小管对H⁺分泌增加不引起
A. Na⁺吸收增加
B. HCO₃⁻重吸收增加
C. NH₃分泌增加
D. K⁺分泌增加
E. 水重吸收增加

正确答案：D。K⁺分泌增加